我国目前HBsAg携带者中有1/3～1/2最可能的受染途径是
A. 经输血传播
B. 母婴传播
C. 经微量血传播
D. 经口传播
E. 经精子和卵子种系传播

正确答案：B。母婴传播

解析：本题考查乙肝的重要传播途径。母婴传播（B对ACDE错）又称垂直传播，是指乙肝病毒由患急性或慢性乙肝感染的母亲传播给婴儿。这一传播途径在疾病的扩散中发挥重要作用，是人群中HBV感染者积累的重要原因。